阴阳转化的内在依据是
A. 阴阳消长
B. 阴阳互根
C. 阴阳平衡
D. 阴阳对立
E. 阴阳制约

正确答案：B。阴阳互根

解析：本题考查的是阴阳的互根互用。阴阳转化的内在依据是阴阳互根（B对）。阴阳的互根互用，是阴阳转化的内在根据。由于阴和阳本来就是相互关联事物的对立双方，或本是一个事物内部的对立双方，因而阴和阳在一定的条件下，可以各自向着自己相反的方面转化。阴阳的消长平衡（AC错），是指在一定的限度内，阴或阳的运动变化出现减少或增加的量变形式。阴阳对立（D错），是指事物或现象中阴与阳两个方面，具有阴阳相反、相互制约的关系，又称“阴阳对待”。阴阳学说认为，自然界一切事物或现象都存在着相互对立、相反相成的两个方面。